苯丙酮尿症是属于
A. 染色体畸变
B. 常染色体显性遗传
C. 常染色体隐性遗传
D. X连锁显性遗传
E. X连锁隐性遗传

正确答案：C。常染色体隐性遗传